心脏前负荷增加可发生于下列哪一种情况
A. 肺动脉瓣狭窄
B. 主动脉瓣狭窄
C. 高血压
D. 肺栓塞
E. 严重贫血

正确答案：E。严重贫血

解析：心功能不全的病因分为心肌收缩性降低、心室负荷过重、心室舒张及充盈受限。其中心室负荷过重分为前负荷过重、后负荷过重。严重贫血（E对）时，外周血管阻力降低，静脉回心血量增加，心室舒张期充盈压升高，使心脏收缩前承受的负荷即前负荷增加。肺动脉瓣狭窄（A错）、主动脉瓣狭窄（B错）、高血压（C错）、肺栓塞（D错）可使体循环或肺循环阻力增加，导致心室射血时克服的阻力增加即后负荷增加。